硫脲类抗甲状腺药在临床主要用于
A. 甲亢的内科治疗
B. 呆小病的替代治疗
C. 甲状腺手术前准备
D. 黏液性水肿的治疗
E. 甲状腺危象的辅助治疗

正确答案：A、C、E。甲亢的内科治疗；甲状腺手术前准备；甲状腺危象的辅助治疗